抗凝血酶的作用是
A. 封闭凝血因子活性中心
B. 抑制PC
C. 抑制血小板凝聚
D. 抑制TXA形成
E. 增加溶解

正确答案：A。封闭凝血因子活性中心

解析：抗凝血酶能与内源性凝血途径产生的凝血酶、FⅨa、FⅩa、FⅪa和FⅫa等分子活性中心的丝氨酸残基结合，封闭凝血因子活性中心（A对）而抑制其活性。PC（蛋白质C）（B错）系统（P77）为生理性抗凝物质，抑制PC则生理性抗凝作用减弱，凝血增强，与题干不符。抑制血小板凝聚（C错）、抑制TXA形成（D错）及增加溶解（E错）与抗凝血酶的作用无关。